高血压危重症的治疗，应迅速将血压降到安全范围的是
A. 120/80mmhg以内
B. 130/85mmhg以内
C. 140/90mmhg以内
D. 150/95mmhg以内
E. 160/100mmhg以内

正确答案：E。160/100mmhg以内

解析：高血压急症在短时间内血压急骤下降，有可能使重要器官的血流灌注明显减少，应采取逐步控制性降压，一般情况下，初始阶段（数分钟到一小时内）血压控制的目标为平均动脉压的降低幅度不超过治疗前水平的25%；在随后的2~6小时内将血压降至较安全水平，一般为160/100mmHg左右（E对ABCD错）；如果可以耐受，临床情况稳定，在随后24~48h小时逐步降至正常水平。